男，18岁。发热伴颈部淋巴结进行性无痛性肿大3个月，最高体温38.7℃。血常规WBC8.0×10⁹/L，N0.70，L0.30；骨髓细胞学检查未见异常；淋巴结活检可见里-斯（R-S）细胞。最可能的诊断为
A. 霍奇金淋巴瘤
B. 淋巴结转移癌
C. 非霍奇金淋巴瘤
D. 急性淋巴细胞白血病
E. 急性粒细胞白血病

正确答案：A。霍奇金淋巴瘤

解析：患者青年男性，发热伴颈部淋巴结进行性无痛性肿大3个月（霍奇金淋巴瘤首发症状常是无痛性颈部或锁骨上淋巴结进行性肿大，常见的全身症状有发热、盗汗、瘙痒及消瘦等），血常规WBC8.0×10⁹/L（正常4～10×10⁹/L）正常，N0.70，L0.30（N中性粒细胞比例正常0.50～0.75；L淋巴细胞比例正常0.20～0.40），分类基本正常，淋巴结活检可见里-斯细胞（R-S细胞）（R-S细胞对霍奇金淋巴瘤有确诊意义），故患者最可能的诊断是霍奇金淋巴瘤（A对）。淋巴结转移癌（B错）常有原发肿瘤的症状，淋巴结活检一般无里-斯细胞；非霍奇金淋巴瘤（P588）（C错）也常表现为进行性无痛性淋巴结肿大，但外周血中淋巴细胞绝对或相对增加，淋巴结活检无里-斯细胞；急性淋巴细胞白血病（P571）（D错）常见淋巴结肿大，外周血白细胞常增多，骨髓活检原始细胞、幼淋巴细胞增多；急性粒细胞白血病（P571）（E错）外周血白细胞常增多，骨髓活检原粒细胞增多。